男，32岁，恶心、呕吐、腹胀、乏力4天，发热、胡言乱语1天。既往无肝病史。查体：巩膜明显黄染，肝浊音界缩小，扑翼样震颤阳性。实验室检查：血ALT130U/L，TBil240mol/L。该患者的肝脏可能发生的主要病理改变是
A. 肝淤血性改变
B. 假小叶形成
C. 肝细胞气球样变
D. 肝细胞广泛坏死
E. 肝细胞碎屑样坏死

正确答案：D。肝细胞广泛坏死

解析：青年男性患者，恶心呕吐、腹胀乏力4天，查体见巩膜黄染、肝浊音界缩小，ALT（谷丙转氨酶，正常值为5-40U/L）、TBil（总胆红素，正常值为3.4-17.1μmol/L）升高，病程短且已出现肝性脑病的表现（胡言乱语1天、扑翼样震颤阳性），考虑诊断为急性重型肝炎。急性重型肝炎的主要病理改变是肝细胞广泛坏死（D对）。肝淤血性改变（A错）主要见于右心衰竭，此例无下肢水肿、颈静脉怒张等右心衰竭的表现。假小叶形成（B错）是肝硬化的特征性改变（P201）。肝细胞气球样变（C错）见于急性普通型肝炎（P198）。肝细胞碎屑样坏死（E错）常见于慢性肝炎。